两个直肠柱基底之间有半月形的黏膜皱襞，称为
A. 直肠瓣
B. 肛瓣
C. 肛窦
D. 齿状线
E. 直肠窝

正确答案：B。肛瓣

解析：肛瓣（B对）：各直肠柱下端之间借半月形的黏膜皱襞相连，这些半月形黏膜皱襞称为肛瓣。直肠腔内有3个半月形的皱襞，称为直肠瓣（A错），其主要作用是防止粪便的逆行。肛窦（C错）：或称肛隐窝，是位于直肠柱与肛瓣之间向上开口的袋状间隙，呈漏斗形。齿线（D错）：肛瓣与直肠柱的基底在直肠与肛管交界处形成的一条不整齐的交界线，齿线的上下组织结构明显不同，是临床上的重要标记线。直肠窝（E错）：位于肛管两侧，呈楔形。